男性，50岁。既往乙型肝炎病史20余年，今晨突发呕血，色鲜红，量约为1500ml，急至医院就诊，查体：BP80/50mmHg，P106次/分，面色苍白，四肢末梢凉，脾于肋下缘5cm可触及，移动性浊音（+），腹壁可见静脉曲张，至医院后患者又呕血一次，量约300ml.不恰当的方法是
A. 三腔二囊管压迫
B. 血管加压素静点
C. 急诊剖腹探查止血
D. 输血
E. 纤维胃镜介入治疗

正确答案：C。急诊剖腹探查止血

解析：中年患者乙肝病史20余年（可发展为肝炎后肝硬化），脾肋下缘5cm（脾大），移动浊音阳性（腹水），腹壁可见静脉曲张（门静脉高压严重），根据临床表现及病史，诊断为肝硬化。食管胃底静脉离门静脉主干和腔静脉最近，压力差最显著，受门静脉高压也最早最明显。突发呕血1500mL（量大），最可能的原因是食管胃底静脉曲张破裂。患者有腹水，提示肝功能较差，应采用非手术治疗。急诊剖腹探查，止血（C错，为本题正确答案）属手术治疗，不适用患者。三腔二囊管压迫（A对）、血管加压素静点（B对）、输血（D对）、纤维胃镜介入治疗（E对）属非手术治疗，适用于患者。